母核为苄基四氢异喹啉结构的肌松药是
A. 氯化琥珀胆碱
B. 苯磺酸阿曲库铵
C. 泮库溴铵
D. 溴新斯的明
E. 溴丙胺太林

正确答案：B。苯磺酸阿曲库铵